患者，女，50岁。家属代诉刚才与人争吵，突然昏倒，不省人事。见面色苍白，汗出，四肢逆冷，脉细缓。治疗应首选
A. 百会、神庭、印堂、太阳
B. 百会、囟会、人中、承浆
C. 通天、四神聪、神门、液门
D. 人中、合谷、足三里、中冲
E. 三阴交、合谷、神门、大陵

正确答案：D。人中、合谷、足三里、中冲

解析：本题考查常见的病症的辩证、处方。题中女，50岁，与人争吵，突然昏倒，不省人事。见面色苍白，汗出，四肢逆冷，脉细缓，可辩证为晕厥。百会、神庭、印堂、太阳等穴合用可用于治疗精神分裂症、癫痫等病症（A错）。百会、囟会、人中、承浆合用可用于治疗头面部等疾病（B错）。通天、四神聪、神门、液门合用可用于治疗失眠相关疾病（C错）。人中、合谷、足三里、中冲合用可用于治疗晕厥（D对）。三阴交、合谷、神门、大陵合用可用于治疗心悸等病症（E错）。